阿托品禁用于
A. 虹膜睫状体炎
B. 有机磷中毒
C. 酸中毒
D. 青光眼
E. 休克

正确答案：D。青光眼

解析：本题考查阿托品的禁忌症。阿托品具有扩瞳、升高眼内压作用，禁用于青光眼（D对）；阿托品能够松弛胃肠道平滑肌、解救有机磷酸酯类农药中毒（B错）、酸中毒（C错）以及抗休克（E错）；还可与新斯的明合用抗虹膜睫状肌炎（A错）。